乙状结肠扭转的典型X线征象是
A. 充盈缺损
B. 鹅卵石征
C. 杯口征
D. 铅管征
E. 鸟嘴征

正确答案：E。鸟嘴征

解析：乙状结肠肠扭转钡剂灌肠时，扭转部位钡剂受阻，钡影尖端呈‘鸟嘴’形，称鸟嘴征（E对）。充盈缺损（A错）多见于占位性病变，如良恶性肿瘤等。鹅卵石征（B错）是克罗恩病典型X线表现。杯口征（C错）是肠套叠典型X线表现。铅管征（D错）主要见于溃疡性结肠炎。